相对危险度（RR）是队列研究中反映暴露与发病（死亡）关联强度的指标，下列说法哪一个是正确的
A. RR 95%CI的上限﹥1，认为暴露与疾病呈正关联，即暴露因素是疾病的危险因素
B. RR 95%CI的下限﹤1，认为暴露与疾病呈负关联，即暴露因素是保护因素
C. RR 95%CI的下限﹥1，认为暴露与疾病呈负关联，即暴露因素是保护因素
D. RR 95%CI包括1，则认为暴露因素与疾病有统计学联系
E. RR 95%CI包括1，则认为暴露因素与疾病无统计学联系

正确答案：E。RR 95%CI包括1，则认为暴露因素与疾病无统计学联系